女，62岁。既往体健，绝经10年。因阴道不规则流血、流液3个月入院。查体：宫颈肥大，后唇见一菜花状肿物，累及后穹窿部，质脆，触之易出血，直径约3cm，三合诊示子宫稍大，双侧附件未触及明显异常。宫颈活检示鳞状细胞癌。其最佳治疗方案是
A. 筋膜外子宫切除术及盆腔淋巴结切除术
B. 根治性子宫切除术及盆腔淋巴结切除术
C. 放疗
D. 化疗
E. 化疗后子宫切除术

正确答案：B。根治性子宫切除术及盆腔淋巴结切除术